氯丙嗪用药数周或数月患者可出现
A. 恶性高热
B. 血压升高
C. 室颤
D. 药源性帕金森综合征
E. 成瘾

正确答案：D。药源性帕金森综合征

解析：本题考查氯丙嗪的不良反应。氯丙嗪用药数周或数月患者可出现药源性帕金森（D对）。氯丙嗪为一代抗精神病药，其最常引起锥体外系不良反应，即急性肌张力障碍、帕金森综合征、静坐不能、迟发性运动障碍。恶性高热是由麻醉剂诱导的遗传疾病（A错）。常见的抗精神病药物引起的心血管系统的不良反应表现为: 表现为体位性低血压（B错）、心动过速、心动过缓和传导阻滞（C错）。氯丙嗪没有成瘾性（E错）。